关于体育运动导致牙外伤的影响因素，以下说法正确的是
A. 运动的类型
B. 运动场地
C. 运动员的年龄和性别
D. 防护用具的使用
E. 以上均包括

正确答案：E。以上均包括

解析：体育运动是发生牙外伤的主要原因之一。它受下列因素影响：运动的类型、运动场地、运动员的年龄和性别、运动的规模、体育竞赛的水平、防护用具的使用、是否有教练和牙科医生提供指导等。掌握“牙外伤的预防”知识点。